克山病区环境中，多伴有下列哪种元素的缺乏，因而加重了流行强度
A. 氟
B. 钼
C. 钙
D. 锌
E. 碘

正确答案：E。碘

解析：本题考查克山病。克山病是一种与环境低硒有关、多病因综合所导致的地方性心肌病，“环境低硒”是克山病发生、发展、流行的主要原因。研究表明，低硒与低碘之间有一定的协同作用，在克山病区环境中，缺硒的同时多伴有缺碘（E对ABCD错），因而加重了流行强度。